《中国药典》一部规定，中药检品留样的保存期至少应为
A. 3个月
B. 6个月
C. 1年
D. 2年
E. 3年

正确答案：C。1年